用来鉴定蛋白质的技术是
A. Northern印迹杂交
B. 亲和层析
C. Southern印迹杂交
D. Western印迹杂交
E. 离子交换层析

正确答案：D。Western印迹杂交